某男，70岁。冠心病史7年。常感胸痛隐隐，神疲乏力，气短懒言，心悸自汗，舌淡暗苔白，脉弱。近日该患者准备外出旅游，担心旅游劳累，途中发病，自行携带上述不宜服用的中成药，并加倍服用该药，结果出现了舌麻感。这是因为该中成药含有毒中药，此药是
A. 斑蝥
B. 草乌
C. 蟾酥
D. 生半夏
E. 雄黄

正确答案：C。蟾酥

解析：本题考查的是含蟾酥的中成药。加倍服用麝香保心丸。结果出现了麻舌感。这是因为该中成药含有毒中药，此药是蟾酥（C对）。含蟾酥的中成药：六神丸、六应丸、喉症丸、梅花点舌丸、麝香保心丸、麝香通心滴丸等。草乌（B错）为乌头类药物。乌头类药物和含乌头类药物的中成药：1.中药材：川乌、草乌、附子、雪上一枝蒿等。2.中成药：追风丸、追风透骨丸、三七伤药片、附子理中丸、金匮肾气丸、木瓜丸、小金丸、风湿骨痛胶囊、祛风止痛片、祛风舒筋丸、正天丸、右归丸等。含雄黄（E错）的中成药：牛黄解毒丸（片）、六神丸、喉症丸、安宫牛黄丸、牛黄清心丸、牛黄镇惊丸、牛黄抱龙丸、牛黄至宝丸、追风丸、牛黄醒消丸、紫金锭（散）、三品等。含斑蝥（A错）的中成药：癣湿药水、庆余辟瘟丹等含生半夏（D错）的中成药：复方鲜竹沥液、暑湿感冒颗粒、藿香正气口服液、藿香正气水、藿香正气软胶囊、藿香正气滴丸等。